关于牙龈瘤的治疗，以下哪种正确
A. 行单纯摘除术即可
B. 切除瘤体及其周围的牙龈
C. 切除瘤体、周围牙龈及拔除波及牙和牙周膜
D. 切除瘤体、周围牙龈及拔除波及牙和牙周膜，并切除邻近的骨膜与牙槽骨
E. 作瘤区的颌骨方块切除

正确答案：D。切除瘤体、周围牙龈及拔除波及牙和牙周膜，并切除邻近的骨膜与牙槽骨

解析：本题考查牙龈瘤的治疗。关于牙龈瘤的治疗正确的是切除瘤体、周围牙龈及拔除波及牙和牙周膜，并切除邻近的骨膜与牙槽骨（D对）。牙龈瘤的治疗时，应切除瘤体、周围牙龈及拔除波及牙和牙周膜，并切除邻近的骨膜与牙槽骨，这样可以保证治疗彻底，减少复发。同时尽可能保留可以保留的组织，故作瘤区的颌骨方块切除（E错）是没有必要的，会对机体造成过大损伤。行单纯摘除术（A错），切除瘤体及其周围的牙龈（B错），切除瘤体、周围牙龈及拔除波及牙和牙周膜（C错）治疗都不彻底，有可能导致牙龈瘤复发。